可用于开放性和洞穿性创口、窦腔出血
A. 指压止血
B. 包扎止血法
C. 填塞止血法
D. 结扎止血法
E. 药物止血法

正确答案：C。填塞止血法

解析：填塞止血法可用于开放性和洞穿性创口、窦腔出血。先将无菌纱布或碘仿纱条填塞于创口内，再用绷带行加压包扎。在颈部或口底创口填塞纱布时，应注意保持呼吸道通畅，防止发生窒息。鼻腔出血，在确定无脑脊液漏后才可填塞。掌握“口腔颌面部创伤急救”知识点。